舌苔由薄白转为白厚，提示
A. 病邪入里
B. 寒邪化热
C. 邪退正复
D. 热退津复
E. 湿热留恋

正确答案：A。病邪入里

解析：苔由薄白转为白厚为病情加重，薄厚苔反应邪正的盛衰与邪气的深浅，故有薄白转白厚为病邪由表入里（A对）。寒邪化热多为苔白转为苔黄（B错）。邪退正复为病情好转（C错）。热退津复为病情好转（D错）。湿热留恋多为黄腻苔，苔质多不变化（E错）。